30岁，女性。停经41天，突发右下腹撕裂样疼痛1小时就诊，伴里急后重感及心慌。查体：血压80/40mmhg，脉搏114次/分，下腹压痛、反跳痛明显，移动性浊音(﹢），宫颈举痛，后穹隆饱满，子宫如40天妊娠大小，附件区触诊不满意。B超示右附件包块，盆腔积液。临床实用诊断方法:
A. CT检查
B. 尿妊娠试验
C. 后穹窿穿刺
D. 腹腔镜检查
E. 诊断性刮宫

正确答案：C。后穹窿穿刺

解析：30岁，女性。有停经史，突发右下腹撕裂样疼痛（输卵管妊娠流产或破裂时，突感一侧下腹部撕裂样疼痛）。查体：血压下降，心率增快（腹腔内出血较多时的休克表现），移动性浊音(﹢），宫颈举痛，后穹隆饱满（血液积聚于直肠子宫陷凹处的临床表现），B超示右附件包块，盆腔积液。综合该患者的月经史、临床表现及影像学检查首先考虑输卵管妊娠破裂伴腹腔出血，阴道后穹隆穿刺（C对）是简单可靠的诊断方法。CT（A错）检查无较大意义。尿妊娠试验（B错）主要用于早孕的诊断，诊断异位妊娠时需要连续监测hCG，不是最简便实用方法。腹腔镜检查（D错）是异位妊娠诊断的金标准，但不是最简实用的方法。诊断性刮宫（E错）是子宫内膜癌常用的诊断方法。